除了局部振动病，还有哪项生产性有害因素可以引起雷诺现象
A. 低温作业
B. 二异氰酸甲苯酯
C. 苯胺
D. 氯乙烯

正确答案：D。氯乙烯

解析：本题考查雷诺现象的致病原因。长期接触氯乙烯（D对），可引发雷诺现象。低温作业（A错）主要引发体温过低或冻伤。二异氰酸甲苯酯（B错）主要会诱发哮喘。苯胺（C错）主要引起高铁血红蛋白血症。